心内膜炎时心脏杂音产生的主要机制是
A. 血流加速
B. 瓣膜口狭窄
C. 瓣膜关闭不全
D. 异常通道
E. 心脏内有漂浮物

正确答案：E。心脏内有漂浮物

解析：心内膜炎时心脏杂音产生的主要机制是心脏内有漂浮物（E对）。血流加速产生血管杂音，是剧烈运动、严重贫血、高热、甲亢等血管杂音产生的机制（A错）。瓣膜口狭窄为二尖瓣狭窄、主动脉瓣狭窄、肺动脉瓣狭窄、先天性主动脉缩窄等杂音产生的机制（B错）。瓣膜关闭不全为二尖瓣瓣膜关闭不全、主动脉瓣关闭不全等杂音产生的机制（C错）。异常通道是室间隔缺损、动脉导管未闭等杂音产生的机制（D错）。